牙周组织重度破坏且智力低下的患者，应首先考虑的全身疾病是
A. 艾滋病
B. 掌跎角化—牙周破坏综合征
C. 梅毒
D. 糖尿病
E. Down综合征

正确答案：E。Down综合征

解析：本题考查Down综合征的临床表现。牙周组织重度破坏且智力低下的患者，应首先考虑的全身疾病是Down综合征（E对）。Down综合征，又称先天愚型，患者智力低下，牙周破坏与局部刺激量不成正比。艾滋病相关的牙周病损有线性龈红斑、坏死性溃疡性龈炎、坏死性溃疡性牙周炎（A错）。掌跎角化—牙周破坏综合征患者，手掌、足底、膝部及肘部皮肤过度角化及鳞屑、皲裂，牙周组织严重破坏，患者智力及身体发育正常（B错）。先天性梅毒患者表现为：间质性角膜炎、神经性耳聋、半月形切牙、桑葚状磨牙及蕾状磨牙等（C错）。糖尿病是牙周炎的全身易感因素（D错）。